患者，男，50岁，戴用全口义齿后发音不清，此现象最常出现在
A. 讲话时
B. 说话快时
C. 戴牙初期
D. 戴牙2年后
E. 戴牙1年后

正确答案：C。戴牙初期

解析：初戴义齿时可能会有异物感，恶心，发音不清楚，不会用义齿咀嚼等不适现象。掌握“全口义齿初戴”知识点。